淋巴细胞增多见于
A. 病毒性感染
B. 化脓性感染
C. 寄生虫感染
D. 放射病
E. 血清病

正确答案：A。病毒性感染